颈丛的分支不出现
A. 膈神经
B. 耳大神经
C. 枕小神经
D. 颈横神经
E. 枕大神经

正确答案：E。枕大神经

解析：颈丛的主要分支有：枕小神经（C对）、耳大神经（B对）、颈横神经（D对）、锁骨上神经、膈神经（A对E错，为本题正确选项）。